已婚妇女发生宫颈癌的机率比尼姑多，但比妓女少，因此怀疑性生活紊乱可能与宫颈癌有关。这种假说形成的法则属于
A. 求同法
B. 求异法
C. 共变法
D. 类推法
E. 排除法

正确答案：C。共变法

解析：本题考查共变法。共变法认为，当某一现象存在一种变异或发生一种变化时，另一现象相应存在变异或随之发生变化，且不论后者的变异和变化是什么，那么二者间可能存在因果关系。共变法强调的是对剂量-反应关系的考量，当剂量-反应关系存在时，因果关系存在的可能性更大。题中怀疑性生活紊乱可能与宫颈癌有关的假说形成的法则属于共变法（C对ABDE错）。